臭氧消毒
A. 效果好，接触时间长，用量多，不产生三卤甲烷
B. 效果一般，接触时间长，费用高，pH值窄
C. 效果好，用量多，不产生三卤甲烷，接触时间短
D. 效果好，用量少，接触时间短，不产生三卤甲烷
E. 效果差，费用高，pH值宽，不产生三卤甲烷

正确答案：D。效果好，用量少，接触时间短，不产生三卤甲烷

解析：本题考查臭氧消毒的特点。臭氧（O₃）消毒的优点是：消毒效果较Cl0₂和Cl₂好；用量少；接触时间短；pH在6～8.5内均有效；对隐孢子虫和贾第鞭毛虫有较好的灭活效果；不影响水的感官性状，同时还有除臭、色、铁、锰、酚等多种作用；不产生三卤甲烷（D对ABCE错）；用于前处理时尚能促进絮凝和澄清，降低混凝剂用量。缺点是：投资大，费用较氯化消毒高；水中O₃不稳定，易自行分解，且控制和检测O₃需一定的技术，在水中保留时间很短，不能维持管网持续的消毒效率，需要第二消毒剂。